下面关于发育年龄哪一种描述是错误的
A. 发育年龄是心理和生理的成熟度
B. 以某发育指标的平均水平及其正常变异制成标准年龄
C. 发育年龄包括形态年龄、性征年龄、牙齿年龄和骨龄
D. 骨龄是机体成熟程度的标志
E. 12岁女童，身高年龄12岁，骨龄九岁说明发育落后

正确答案：E。12岁女童，身高年龄12岁，骨龄九岁说明发育落后